患者呼吸急促，查体：气管向左偏移。右侧胸廓饱满，叩诊出现实音。应首先考虑的是
A. 右侧胸腔积液
B. 右侧气胸
C. 肺气肿
D. 右侧大叶性肺炎
E. 右侧肺不张

正确答案：A。右侧胸腔积液

解析：患者呼吸急促，气管向左偏移，右侧胸廓饱满，叩诊出现实音，应首先考虑右侧大量胸腔积液（A对）。气胸（B错）大多数起病急骤，患者突感一侧胸痛，大量气胸时，气管向健侧移位，患侧胸部隆起，呼吸运动与触觉语颤减弱，叩诊呈过清音或鼓音，听诊呼吸音减弱或消失。本例患者叩诊出现实音，故不考虑气胸。肺气肿（C错）是早期可无症状或仅在劳动、运动时感到气短。典型肺气肿者胸廓前后径增大，呈桶状胸，呼吸运动减弱，语音震颤减弱，叩诊过清音，气管不移位。大叶性肺炎（D错）主要表现为发热、胸痛、咳吐铁锈色痰、肺部听诊湿啰音、呼吸困难，叩诊稍浊，听诊可有呼吸音减弱及胸膜摩擦音。肺实变期叩诊浊音，触觉语颤增强并可闻及支气管呼吸音。除非病变累及胸膜出现胸腔积液，否则一般不会出现胸廓饱满。右肺不张（E错）由于失去气体充盈的支撑作用，胸廓塌陷，肋间隙缩小，而不会出现胸廓饱满。